有毒工业废渣的处理措施不包括
A. 安全土地填埋
B. 焚烧法
C. 固化法
D. 化学、生物法
E. 压缩、粉碎

正确答案：E。压缩、粉碎

解析：本题考查有毒工业废渣的处理措施。有毒工业废渣的处理措施包括：1.安全土地填埋（A对）：亦称安全化学土地填埋，是一种改进的卫生填埋方法；2.焚烧法（B对）：是高温分解和深度氧化的综合过程。通过焚烧使可燃性的工业废渣氧化分解，达到减少容积，去除毒性，回收能量及副产品的目的。此法适合于有机性工业废渣的处理；3.固化法（C对）：是将水泥、塑料、水玻璃、沥青等凝固剂同有害工业废渣加以混合进行固化。我国主要用于处理放射性废物；4.化学法：是一种利用有害工业废渣的化学性质，通过酸碱中和、氧化还原等方式，将有害工业废渣转化为无害的最终产物；5.生物法（D对）：许多有害工业废渣可以通过生物降解毒性，解除毒性的废物可以被土壤和水体接纳。压缩、粉碎（E错，为本题正确答案）是城市垃圾的处理方法。